双侧关节盘附着松驰
A. 偏向患侧
B. 偏向健侧
C. 先偏向患侧后又回到中线
D. 不偏
E. 开口型歪曲

正确答案：D。不偏

解析：本题考查颞下颌关节紊乱。双侧关节盘附着松弛：颞前或颞后、下颌前或下颌后附着延伸变长。开口型上可无特殊表现（D对），主要是开口过大。